麻醉前为了抑制腺体分泌，保持呼吸道通畅，可选用
A. 毛果芸香碱
B. 新斯的明
C. 阿托品
D. 氯磷定
E. 后马托品

正确答案：C。阿托品